用量不宜过大，常用量为3g-6g的药物是
A. 茯苓
B. 滑石
C. 地肤子
D. 关木通
E. 茵陈蒿

正确答案：D。关木通

解析：该题考查药物的常用量。关木通的常用量为3~6g（D对）。茯苓的常用量为9~15g（A错）。滑石宜包煎，常用量为10~20g（B错）。地肤子的常用量为9~15g（C错）。茵陈蒿（茵陈）的常用量为6~15g，可煎汤熏洗（E错）。